女婴，10个月。腹泻3天，加重2天。暗红色水样便每日10余次，量多，腥臭，伴高热、呕吐、少尿。查体：精神萎靡，呈嗜睡状，前卤眼窝凹陷，皮肤弹性差，心音较低钝，腹胀，肝脾不大。实验室检查：粪镜检有大量脓血细胞，血钠135mmol/L，血钾3.5mmol/L。患儿最可能的诊断是
A. 轮状病毒肠炎
B. 大肠埃希菌肠炎
C. 金黄色葡萄球菌肠炎
D. 细菌性痢疾
E. 真菌性肠炎

正确答案：B。大肠埃希菌肠炎

解析：本例患儿腹泻、暗红色水样便、量多、腥臭、高热、呕吐、少尿，精神萎靡呈嗜睡状，前囟眼窝凹陷，皮肤弹性差，心音较低钝，腹胀，实验室检查：粪镜检有大量脓血细胞，血钠135mmol/L，血钾3.5mmol/L，最可能的诊断是大肠埃希菌肠炎（B对）。轮状病毒肠炎（A错）多无明显感染中毒症状。金黄色葡萄球菌肠炎（C错）多继发于使用大量抗生素后，病程和症状常与菌群失调的程度有关，有时继发于慢性疾病的基础上细菌性痢疾，典型大便为暗绿色，量多带粘液，细菌性痢疾（D错）多先为稀水样便，后转为脓血便。真菌性肠炎（E错）黄色稀便，泡沫较多，带黏液。